吸收铁的主要部位是
A. 胃底部
B. 胃窦部
C. 小肠上部
D. 回肠
E. 结肠

正确答案：C。小肠上部